急性心肌梗死并发症中，心脏破裂发生在
A. 1～2周
B. 2～3周
C. 7天之内
D. 3～4周
E. 4周以上

正确答案：C。7天之内

解析：急性心肌梗死后出现心脏破裂较少见，常发生在7天之内（C对ABDE错），多为心室游离壁破裂，造成心包积血引起急性心脏压塞而猝死。心脏破裂也可为亚急性，患者能存活数月。